根据《执业药师职业道德准则》的要求，若在咨询中知晓本单位甲药师的处方调配存在不当之处，执业药师应
A. 向患者说明甲药师的专业能力的不足，借机宣传自己的专业能力
B. 应联系甲药师等待其本人回来予以纠正
C. 为尊重同行，应告知患者等待甲药师上班时间再来咨询
D. 应积极提供咨询，并给予纠正
E. 药品已售出，应拒绝纠正，但可以为其再提供其他安全、有效药品

正确答案：D。应积极提供咨询，并给予纠正